引起急性肾衰竭发生代谢性酸中毒的机制中正确的是
A. 肾小管泌H+、NH4+功能障碍
B. 固定酸排除增多
C. GFR升高
D. 分解代谢减弱
E. NaHC03重吸收增多

正确答案：A。肾小管泌H+、NH4+功能障碍

解析：代谢性酸中毒发生原因：①GFR降低（C错），使酸性代谢产物在体内蓄积；②肾小管分泌H+和NH4+能力降低（A对），使NaHC03重吸收减少（E错）；③分解代谢增强（D错），固定酸产生增多（B错）。